患者，女，32岁。产后1周，昨日出现恶寒发热，肢体关节疼痛，屈伸不利，怕冷恶风，舌淡，苔薄白，脉浮紧。治疗应首选的方剂是
A. 独活寄生汤
B. 生化汤加桂枝
C. 黄芪桂枝五物汤加味
D. 养荣壮肾汤加秦艽
E. 人参再造丸

正确答案：A。独活寄生汤

解析：患者产后出现肢体关节疼痛，屈伸不利，怕冷恶风诊断为产后关节痛，患者怕冷恶风，舌淡，苔薄白，脉浮紧，是由于产后百脉空虚，卫外不固，腠理疏松，起居不慎，风寒湿邪乘虚入侵，留着于经络、关节、肌肉，凝滞气血，不通则痛，属外感证，故选方独活寄生汤（A对）。生化汤加桂枝主治产后汗多，血虚生风，口噤咬牙，角弓反张（B错）。黄芪桂枝五物汤加味主治卫气亏虚，贼风邪气入侵，寒湿阻滞经络（C错）。养荣壮肾汤加秦艽主治治产后感受风寒，腰痛不可转侧（D错）。人参再造丸用于气虚血瘀、风痰阻络所致的中风，症见口眼歪斜、半身不遂、手足麻木、疼痛、拘挛、言语不清（E错）。